以下有关维生素D缺乏性佝偻病的描述中，最为恰当的一项是
A. 主要是缺磷
B. 主要是缺钙
C. 主要是碱性磷酸酶增高
D. 主要缺乏维生素D3
E. 主要缺乏维生素D，使钙、磷代谢紊乱，产生骨骼病变

正确答案：E。主要缺乏维生素D，使钙、磷代谢紊乱，产生骨骼病变

解析：维生素D缺乏性佝偻病是由于儿童体内维生素D不足使钙、磷代谢紊乱，产生的一种以骨骼病变为特征的全身慢性营养性疾病，主要见于2岁以下婴幼儿。掌握“维生素D缺乏性佝偻病”知识点。